年轻恒牙硬组织比成熟恒牙薄，主要的原因是
A. 钙化程度低
B. 牙釉质薄
C. 牙釉质未发育完全
D. 没有继发性牙本质
E. 牙本质尚未完全形成

正确答案：D。没有继发性牙本质

解析：本题考查年轻恒牙硬组织比成熟恒牙薄的原因。恒牙已萌出，但在形态结构上尚未完全形成和成熟的恒牙称为年轻恒牙。牙齿中含量最高的硬组织为牙本质，继发性牙本质是在牙根发育完成，牙和对（牙合）牙建立了咬合关系之后形成的牙本质。与成熟恒牙相比，年轻恒牙牙根尚未发育完全，牙本质已完全形成（E错），没有继发性牙本质（D对），因此硬组织比成熟恒牙薄。年轻恒牙的釉质在萌出时已基本成熟，无钙化程度低（A错）和牙釉质尚未发育完全（C错）。年轻恒牙釉质矿化程度低，牙釉质薄（B错），但不是年轻恒牙硬组织比成熟恒牙薄的主要原因（B错）。